在社会药店，应由执业药师指导购买、销售和使用的药品是
A. 甲类非处方药
B. 乙类非处方药
C. 口服制剂
D. 外用制剂
E. 复方制剂

正确答案：A。甲类非处方药

解析：本题考查处方药与非处方药流通管理。在社会药店，应由执业药师指导购买、销售和使用的药品是甲类非处方药（A对）。药品主要包括非处方药和处方药，非处方药是不需要医师处方、即可自行判断、购买和使用的药品，简称OTC。为了保证人民健康，我国非处方药的包装标签、使用说明书中标注了警示语，明确规定药物的使用时间、疗程，并强调指出“如症状未缓解或消失应向医师咨询”。处方药是必须凭执业医师或执业助理医师才可调配、购买和使用的药品。国家根据药品的安全性，非处方药又被分为甲、乙两类，就用药安全性而言，乙类非处方药相对于甲类非处方药更安全，而甲类非处方药应由执业药师指导购买、销售和使用。